抑制排卵避孕药的较常见不良反应是
A. 子宫不规则出血
B. 肾功能损害
C. 多毛、痤疮
D. 增加哺乳期妇女的乳汁分泌
E. 乳房肿块

正确答案：A。子宫不规则出血

解析：本题考查避孕药的不良反应。抑制排卵避孕药的常见不良反应有类早孕样反应、胃肠道反应、月经失调、出血（A对）、妊娠斑、体重增加等。避孕药因故漏服后，可能出现子宫不规则出血。